全口义齿固位有关的因素，下列哪一项是错误的
A. 颌骨的解剖形态
B. 口腔黏膜的性质
C. 牙槽骨致密程度
D. 基托的伸展
E. 唾液的质量

正确答案：C。牙槽骨致密程度

解析：影响全口义齿固位的有关因素：①颌骨的解剖形态；②义齿承托区黏膜的性质；③唾液的质量；④义齿基托的边缘伸展。掌握“全口义齿固位及稳定”知识点。